在五输穴中，经气所注为
A. 井
B. 荥
C. 输
D. 经
E. 合

正确答案：C。输

解析：输穴多位于掌指或跖趾关节之后，喻作水流由小而大，由浅注深，是经气渐盛、由此注彼的部位，即所注为输（C对）。井穴（A错）分布在指或趾末端，为经气初出之处；荥穴（B错）分布于掌指或跖趾关节之前，为经气开始流动之处；经穴（D错）多位于腕、踝关节以上之前臂、膝部，其经气盛大流行；合穴（E错）位于肘膝关节附近，其经气充盛且入合于脏腑，即所说的"所出为井，所溜为荥，所注为输，所行为经，所入为合"。